夹闭兔颈总动脉引起血压升高的主要原因是
A. 减压神经传入冲动增多
B. 窦神经传入冲动减少
C. 颈动脉体受到缺O₂刺激
D. 颈动脉窦受到牵拉刺激
E. 颈动脉窦内压升高

正确答案：B。窦神经传入冲动减少